根据牙面解剖形态可以分为两种类型，Ⅰ型为窝沟龋，则Ⅱ型为
A. 点隙龋
B. 隐匿性龋
C. 根面龋
D. 线性釉质龋
E. 平滑面龋

正确答案：E。平滑面龋

解析：根据牙面解剖形态可以分为两种类型：Ⅰ型为窝沟龋；Ⅱ型为平滑面龋。掌握“龋病的临床表现与分类”知识点。